属于核苷类抗病毒药的是
A. 阿米卡星
B. 红霉素
C. 土霉素
D. 阿昔洛韦
E. 利福喷汀

正确答案：D。阿昔洛韦

解析：本题考查核苷类抗病毒药。属于核苷类抗病毒药的是阿昔洛韦（D对）。阿昔洛韦又名无环鸟苷，属人工合成的鸟嘌呤核苷类似物，能选择性地抑制病毒DNA聚合酶。同类药物还有更昔洛韦、伐昔洛韦等。阿米卡星（A错）为氨基糖苷类抗生素。红霉素（B错）为大环内脂类抗生素。土霉素（C错）为四环素类抗生素。利福喷丁（E错）为抗结核药。